义齿承受的（牙合）力，主要由天然牙承担的义齿类型为
A. 金属铸造支架式义齿
B. 牙支持式义齿
C. 胶连式义齿
D. 牙与黏膜混合支持式义齿
E. 黏膜支持式义齿

正确答案：B。牙支持式义齿

解析：牙支持式义齿：义齿承受的（牙合）力，主要通过位于缺隙两端基牙上的（牙合）支托，传递至基牙，主要由天然牙承担。掌握“局部义齿类型，肯氏分类及模型观测”知识点。